上颌义齿后部基托伸展过长
A. 哨音
B. 恶心
C. 咬颊
D. 咬唇
E. 弹响

正确答案：B。恶心

解析：部分患者在初戴义齿时，常出现恶心，甚至呕吐。常见的原因是由于上颌义齿后缘伸展过长或义齿基托后缘与口腔黏膜不密合。掌握“全口义齿戴入后问题及处理”知识点。